慢性呼吸性酸中毒血气分析参数的变化是
A. PaCO₂增高
B. pH降低
C. SB、AB、BB均升高，AB>SB
D. BE正值增大
E. 以上都是

正确答案：E。以上都是

解析：发生慢性呼吸性酸中毒，机体吸入过多CO2或无法排出引起体内H+蓄积，PH降低（B对），PaC02增高（A对），通过机体肾、血液、细胞的代偿作用后，体内的HCO3-浓度上升，SB、AB、BB均升高，AB＞SB（C对）,BE正值增大（D对，故E为本题正确答案）。